某女，26岁，新患湿热痹症，症见足膝红肿，筋骨疼痛。宜选用的成药是
A. 天麻丸
B. 木瓜丸
C. 四妙丸
D. 尪痹颗粒
E. 颈复康颗粒

正确答案：C。四妙丸

解析：本题考查的是四妙丸的主治。新患湿热痹症，症见足膝红肿，筋骨疼痛。宜选用的成药是四妙丸（C对）。四妙丸：【主治】湿热下注所致的痹病，症见足膝红肿、筋骨疼痛。天麻丸（A错）：【主治】风湿瘀阻、肝肾不足所致的痹病，症见肢体拘挛、手足麻木、腰腿酸痛。木瓜丸（B错）：【主治】风寒湿痹阻所致的痹病，症见关节疼痛、肿胀、屈伸不利、局部恶风寒、肢体麻木、腰膝酸软。尪痹颗粒（D错）：【主治】肝肾不足、风湿痹阻所致的尪痹，症见肌肉、关节疼痛、局部肿大、僵硬畸形、屈伸不利、腰膝酸软、畏寒乏力；类风湿关节炎见上述证候者。颈复康颗粒（E错）：【主治】风湿瘀阻所致的颈椎病，症见头晕、颈项僵硬、肩背酸痛、手臂麻木。